痛风发作期禁用
A. 碳酸氢钠
B. 别嘌醇
C. 布洛芬
D. 萘普生
E. 泼尼松

正确答案：B。别嘌醇

解析：本题考查痛风治疗药。在痛风急性发作期禁用抑制尿酸生成药，如别嘌醇（B对）。碳酸氢钠（A错）用于痛风治疗药丙磺舒服药时期碱化尿液。布洛芬（C错）可用于控制痛风急性发作。泼尼松（E错）适用于痛风急性发作，可迅速缓解症状，但停药后易复发。萘普生（D错）有抗炎、解热、镇痛作用。